下列结构组成咽淋巴环
A. 喉扁桃体、腭扁桃体和舌扁桃体
B. 咽扁桃体、腭扁桃体和舌扁桃体
C. 鼻扁桃体、腭扁桃体和舌扁桃体
D. 腭扁桃体和舌扁桃体
E. 腭扁桃体和咽扁桃体

正确答案：B。咽扁桃体、腭扁桃体和舌扁桃体

解析：咽扁桃体、腭扁桃体、舌扁桃体(B对)及咽鼓管扁桃体共同构成咽淋巴环。